甲型肝炎和戊型肝炎共有的主要传播途径是
A. 粪-口传播
B. 母婴传播
C. 血液传播
D. 体液传播
E. 性传播

正确答案：A。粪-口传播

解析：甲型肝炎和戊型肝炎的传播途径均为粪-口传播（A对）。乙型肝炎的传播途径主要为母婴传播（B错）、血液和体液传播（CD错）、性传播（E错）。丙型肝炎的传播途径主要为输血及血制品，注射、针刺、器官移植、骨髓移植、血液透析，性传播。丁型肝炎与乙型肝炎相似。